对偶三角瓣适用于
A. 整复带邻近组织的缺损
B. 松解挛缩的瘢痕
C. 覆盖感染的创面
D. 作毛发的移植
E. 器官再造

正确答案：B。松解挛缩的瘢痕

解析：移位皮瓣：又名对偶三角交叉皮瓣或Z字成形术，这种皮瓣多应用于狭长形的索状瘢痕挛缩；也可用于恢复错位的组织或器官的正常位置与功能；以及用于长切口的闭合以预防术后瘢痕挛缩。掌握“皮瓣移植”知识点。